下列具有清热生津，止呕除烦功效的药物是
A. 大青叶
B. 鱼腥草
C. 夏枯草
D. 蒲公英
E. 芦根

正确答案：E。芦根

解析：芦根的功效是清热泻火，生津止渴，除烦，止呕，利尿（E对）。大青叶（A错）的功效是清热解毒，凉血消斑。鱼腥草（B错）的功效是清热解毒，消痈排脓，利尿通淋。夏枯草（C错）的功效是清肝泻火，明目，散结消肿。蒲公英（D错）的功效是清热解毒，消肿散结，利湿通淋。